具有峻下冷积功效的药物是
A. 巴豆
B. 大黄
C. 火麻仁
D. 郁李仁
E. 松子仁

正确答案：A。巴豆

解析：巴豆的功效是峻下冷积，逐水退肿，祛痰利咽，外用蚀疮（A对）。大黄的功效是泄下攻积，清热泻火，凉血解毒，逐瘀通经不具有峻下冷积的功效（B错）。火麻仁的功效是润肠通便不具有峻下冷积的功效（C错）。郁李仁的功效是润肠通便，利水消肿不具有峻下冷积的功效（D错）。松子仁的功效是润肠通便，润肺止咳不具有峻下冷积的功效（E错）综上可知具有峻下冷积功效的药物是巴豆。